围绝经期的定义
A. 指妇女绝经前后的一段时期
B. 是正常的生理过程
C. 易患围绝经期综合征
D. 正常生理过程，不必保健
E. 必要时可行激素替代

正确答案：A。指妇女绝经前后的一段时期

解析：本题考查围绝经期的定义。围绝经期指从接近绝经时出现与绝经有关的内分泌和临床表现时起至绝经后1年内的期间，妇女绝经前后的一段时期（A对BCDE错），此期包括绝经过渡期及绝经后一年，与绝经后期有约一年的重叠。